食管上端平
A. 第4颈椎下缘
B. 第5颈椎下缘
C. 第6颈椎下缘
D. 第7颈椎下缘
E. 第1胸椎下缘

正确答案：C。第6颈椎下缘

解析：食管上端平第6颈椎下缘(C对)。